24岁女性，停经58天，13天前行人工流产吸宫术。术后持续阴道流血。初步考虑的诊断是
A. 子宫穿孔
B. 吸宫不全
C. 子宫内膜炎
D. 子宫复旧不良
E. 漏吸

正确答案：B。吸宫不全

解析：患者为青年女性，停经后行人工流产吸宫术，术后持续阴道流血（手术后阴道流血时间长，血量多或流血停止后再现多量流血，应考虑为吸宫不全），初步考虑的诊断是吸宫不全（B对）。子宫穿孔（A错）是指手术时突然感到无宫底感觉，或手术器械进入深度超过原来所测得深度。漏吸（E错）是指施行人工流产术未吸出胚胎及绒毛而导致继续妊娠或胚胎停止发育。子宫内膜炎（C错）常表现为高热、头痛、白细胞增高、阴道脓血性分泌物等，无阴道持续流血。若胎盘附着面感染，子宫复旧不良（D错）引起出血，常表现为大量阴道出血。